肺炎链球菌肺炎消散后肺组织结构的变化是
A. 肺泡壁纤维化
B. 恢复正常
C. 细支气管狭窄
D. 支气管扩张
E. 肺大泡形成

正确答案：B。恢复正常

解析：肺炎链球菌为革兰阳性菌，不产生毒素，不引起组织坏死或形成空洞，其致病力主要为多糖荚膜对组织的侵袭作用，主要表现为肺泡水肿与炎性渗出等，对组织破坏力较弱，肺炎消散后，肺组织结构多恢复正常（B对）。而肺泡壁纤维化（A错）为特发性肺纤维化的病理改变。细支气管狭窄（C错）、肺大泡形成（E错）为慢性阻塞性肺疾病的病理改变。支气管扩张（D错）见于急慢性呼吸道感染和支气管阻塞后的病理改变。